患者，男，34岁，既往有胃溃疡病史，现因反复关节疼痛、肿大就诊，诊断为骨关节炎，应选用的药物是
A. 布洛芬
B. 塞来昔布
C. 萘普生
D. 吲哚美辛
E. 双氯芬酸

正确答案：B。塞来昔布

解析：本题考查塞来昔布。应选用的药物是塞来昔布（B对）。塞来昔布为抗炎和抗风湿药，用于缓解骨关节炎的症状和体征、缓解成人类风湿关节炎的症状和体征、治疗成人急性疼痛、缓解强直性脊柱炎的症状和体征。由题干可知，该患者既往有胃溃疡病史，可选用非选择性NSAIDs加用抑酸药物、米索前列醇等胃黏膜保护剂，或选择性COX-2抑制剂（如塞来昔布）。布洛芬（A错）用于缓解轻至中度疼痛如头痛、关节痛、偏头痛、牙痛、肌肉痛、神经痛、痛经。也用于普通感冒或流行性感冒引起的发热。萘普生（C错）用于治疗风湿性和类风湿性关节炎、骨关节炎、强直性脊柱炎、痛风、关节炎、腱鞘炎，亦可用于缓解骨肉骨骼扭伤、挫伤、损伤以及痛经等所致的疼痛，栓剂用于宫腔手术和检查时的镇痛，如早期妊娠的人工流产手术、诊断性刮宫术、清宫术、节育环安取术及子官内窥镜检查手术。吲哚美辛（D错）用于各类关节炎、软组织损伤、各种疼痛等。双氯芬酸（E错）用于急性关节炎症和痛风发作、慢性关节炎症、类风湿性关节炎、强直性脊柱关节和脊柱的其他炎性风湿性疾病、与关节和脊柱的退行性疾病有关的疼痛、软组织风湿病、创伤或手术后的肿痛或炎症，治疗痛经和由整形、牙科手术或其他外科小手术引起的术后痛和炎症，也用于眼科手术后非细菌性炎症的治疗。